慢性胃炎脾胃虚寒证的治法是
A. 温中散寒
B. 健脾温中
C. 益气养胃
D. 理气和胃
E. 疏肝健脾

正确答案：B。健脾温中

解析：慢性胃炎脾胃虚寒证需健脾温中（B对），和胃止痛。温中散寒（A错）治疗实寒证。益气养胃（C错）治疗气虚证。理气和胃（D错）治疗气滞证。疏肝健脾（E错）治疗肝郁脾虚证。